以下被称为背景资料，可依研究目的决定需收集的信息的是
A. 口腔健康行为
B. 口腔健康知识
C. 口腔健康相关生活质量
D. 口腔健康态度
E. 研究对象的属性资料

正确答案：E。研究对象的属性资料

解析：研究对象的属性资料也称为背景资料，可依研究目的决定需收集的信息。掌握“口腔健康问卷调查”知识点。